荆防颗粒除能发汗解表外，又能
A. 理气散寒
B. 散风祛湿
C. 疏风清热
D. 清热解毒
E. 降逆平喘

正确答案：B。散风祛湿

解析：本题考查的是荆防颗粒的功能。荆防颗粒除能发汗解表外，又能散风祛湿（B对）。荆防颗粒：【功能】解表散寒，祛风胜湿。紫苏：【性能特点】本品辛温行散。入肺经，散寒而发表；入脾经，理气而宽中、安胎，兼解鱼蟹毒。发汗不如麻黄、桂枝，长于理气（A错）、安胎、解毒。风寒感冒兼气滞，以及气滞胎动不安者用之最宜。亦作食品。【功效】发表散寒，行气宽中，安胎，解鱼蟹毒。桑菊感冒片：【功能】疏风清热（C错），宣肺止咳。银翘解毒丸：【功能】疏风解表，清热解毒（D错）。降逆平喘（E错）为泄热平喘剂的功能。泄热平喘剂主要具有清肺泄热、降逆平喘等作用，主治肺热喘息，症见发热、咳嗽、气喘、咯痰黄稠等。